关于同工酶的叙述哪一项是正确的
A. 酶分子的一级结构相同
B. 催化的化学反应相同
C. 各同工酶Km相同
D. 同工酶的生物学功能相同
E. 同工酶的理化性质相同

正确答案：B。催化的化学反应相同

解析：有些酶虽然其蛋白质一级结构存在差异，但其活性中心的三维结构相同或相似，可以催化相同的化学反应。同工酶是指催化相同的化学反应，但酶蛋白的分子结构、理化性质乃至免疫学性质不同的一组酶。掌握“酶活性调节（抑制与激活）”知识点。